关于卡前列甲酯栓贮存条件的说法，正确的是
A. 遮光、密闭，5℃以下保存
B. 遮光、密闭，-5℃以下保存
C. 遮光、密闭，5℃以上保存
D. 遮光、密闭，室温下保存
E. 遮光、密闭，阴凉处保存

正确答案：B。遮光、密闭，-5℃以下保存

解析：本题考查卡前列甲酯栓的贮存条件。卡前列甲酯栓的贮存条件为遮光、密闭，-5℃以下保存（B对）。